下列哪种组织细胞再生能力最强
A. 骨骼肌细胞
B. 神经细胞
C. 软骨细胞
D. 心肌
E. 神经胶质细胞

正确答案：E。神经胶质细胞

解析：根据细胞再生能力的不同，分为不稳定细胞、稳定细胞和永久性细胞三类细胞。其中，不稳定细胞再生能力最强，稳定细胞再生能力次之，永久性细胞无再生能力。骨骼肌细胞（A错）、神经细胞（B错）和心肌细胞（D错）均属于永久性细胞，无再生能力；神经胶质细胞（E对）属于稳定细胞，在生理情况下增殖不明显，但受到损伤刺激时可表现出较强的再生能力。软骨细胞（C错）也属于稳定细胞，但软骨细胞的再生能力较弱（但有再生能力），软骨组织缺损较大时需要由纤维组织参与修补。